影响中药制剂稳定性的因素有
A. 药物性质
B. 辅料
C. 制剂工艺
D. 剂型设计
E. 贮藏条件

正确答案：A、B、C、D、E。药物性质；辅料；制剂工艺；剂型设计；贮藏条件

解析：本题考查的是中药制剂稳定性。影响中药制剂稳定性的因素有药物性质（A对）、辅料（B对）、制剂工艺（C对）、剂型设计（D对）、贮藏条件（E对）。影响中药制剂稳定性的因素：1.处方因素（1）pH（2）溶剂、基质及其他辅料的影响2.制剂工艺同种药物的不同剂型，乃至同种剂型的不同工艺，其稳定性差异较大。因此，应根据药物性质，结合临床需要，设计合理的剂型和制剂工艺，以提高制剂的稳定性。3.贮藏条件（1）温度（2）光线（3）氧气和金属离子（4）湿度和水分（5）包装材料玻璃、塑料、橡胶和金属等包装材料与药物相互作用可引起药物稳定性发生变化。